邻面浅龋的最常使用的常规诊断方法是
A. X线片检查
B. 探诊检查
C. 菌斑染色
D. 荧光显示法
E. 冷热诊

正确答案：A。X线片检查

解析：浅龋一般可用探针在探诊时发现，或在拍X线片时发现。最常使用的常规诊断方法是做X线检查，有利于发现隐匿部位的龋损。此题考察本科教材的原文内容。掌握“龋病的临床表现与分类”知识点。